治着痹的主要方法是
A. 祛风通络
B. 补肾祛瘀
C. 祛湿通络
D. 温经散寒
E. 活血通络

正确答案：C。祛湿通络

解析：本题考查的是痹证的辨证论治。治着痹的主要方法是祛湿通络（C对）。痹证是由于风、寒、湿、热等邪气闭阻经络，影响气血运行，导致肢体筋骨、关节、肌肉等处发生疼痛、重着、酸楚、麻木，或关节屈伸不利、僵硬、肿大、变形等症状的疾病。（一）行痹：【治法】祛风通络（A错），散寒除湿。（二）痛痹：【治法】散寒通络（D错），祛风除湿。（三）着痹：【治法】除湿通络，祛风散寒。（四）尪痹：【治法】化痰祛瘀，滋养肝肾（B错）。活血通络（E错）为中风风阳上扰证的治法。中风风阳上扰证：【治法】平肝潜阳，活血通络。